以下选项哪一个是由病理性牙髓充血发展而来
A. 牙发育期间
B. 月经期
C. 妊娠期牙髓
D. 急性牙髓炎
E. 高空飞行

正确答案：D。急性牙髓炎

解析：本题考查急性牙髓炎。急性牙髓炎（D对）是由病理性牙髓充血发展而来。牙髓充血有生理性与病理性两种，生理性充血见于牙发育期、月经期、妊娠期牙髓，此外，高空飞行时由于气压下降，牙髓呈现暂时充血状态。而急性牙髓炎多数由牙髓病理性充血发展而来，或为慢性牙髓炎的急性发作。